拇长屈肌
A. 起自肱骨内上髁
B. 止于拇指近节指骨
C. 位于指深屈肌尺侧
D. 屈拇指远节指骨
E. 属手肌的外侧群肌

正确答案：D。屈拇指远节指骨

解析：拇长屈肌起自桡骨上端前面，而非肱骨内上髁（A错），止于拇指远节指骨，而非拇指近节指骨（B错），位于指深屈肌外侧，即桡侧，而非尺侧（C错），屈拇指远节指骨（D对）和掌指关节，属前臂的前群肌，而非手肌的外侧群肌（E错）。